在无细菌参与的情况下，酸将牙面化学侵蚀引起慢性、病理性的硬组织丧失，称为
A. 氟牙症
B. 四环素牙
C. 酸蚀症
D. 龋病
E. （牙合）创伤

正确答案：C。酸蚀症

解析：牙酸蚀症是指在无细菌参与的情况下，接触牙面的酸或其螯合物的化学侵蚀作用而引起的慢性的、病理性的牙体硬组织丧失。掌握“酸蚀症的预防”知识点。